治疗鼓胀湿热蕴结证，应首选
A. 柴胡疏肝散
B. 胃苓汤
C. 茵陈蒿汤合中满分消丸
D. 五苓散
E. 一贯煎

正确答案：C。茵陈蒿汤合中满分消丸

解析：茵陈蒿汤合中满分消丸可以清热利湿，攻下逐水，用于治疗鼓胀湿热蕴结证（C对）。柴胡疏肝散（A错）合胃苓汤（B错）用于治疗气滞湿阻证。五苓散（D错）用于治疗脾肾阳虚证。一贯煎（E错）用于治疗肝肾阴虚证。